错误的是
A. 心前面位于胸骨体和第2~6肋软骨之后
B. 心后面平对第5~8胸椎
C. 心上方连接进出心的大血管
D. 心后方与食管和气管相邻
E. 心两侧邻接纵隔胸膜和肺之间互不吻合

正确答案：D。心后方与食管和气管相邻

解析：心前面位于胸骨体和第2-6肋软骨之后（A对）。心后面平对第5-8胸椎（B对）。心上方连接进出心的大血管（C对）。心不与（D错，为本题正确答案）食管和气管相邻。心两侧邻接纵隔胸膜和肺之间互不吻合（E对）。